含氮有机物在土壤微生物的作用下，首先
A. 氨化，再进一步硝化
B. 腐殖质化，再硝化
C. 腐殖质化，再无机化
D. 无机化，再腐殖质化
E. 硝化，再氨化

正确答案：A。氨化，再进一步硝化

解析：本题考查土壤氮素循环的过程。含氮有机物在土壤微生物的作用下，使含氮有机质分解，是土壤氮素循环的主要过程。其过程主要包括：1.氨化作用：指微生物分解有机氮化合物释放出氨的过程。2.硝化作用（A对BCDE错）：指微生物氧化氨为硝酸并从中获得能量的过程，也称硝化过程。3.反硝化作用：指在厌氧条件如水淹、有机质含量过高情况下，微生物将硝酸盐还原为还原态含氮化合物或分子态氮的过程，也称反硝化过程。